某女，68岁。素患青光眼，刻下心悸不安，胸闷气短，动则尤甚，面色苍白，形寒肢冷，下肢浮肿，夜间不能平卧；舌淡苔白，脉虚弱。诊断为心悸。根据辨证结果，宜采用的治法是
A. 补血养心，益气安神
B. 活血化瘀，理气通络
C. 滋阴清火，养心安神
D. 温补心阳，安神定悸
E. 宣通心阳，祛痰活血

正确答案：D。温补心阳，安神定悸

解析：本题考查心悸之心阳不振证的治法。结合患者症状为心悸之心阳不振证，治法为温补心阳，安神定悸（D对）。心悸之心阳不振证【症状】心悸不安，胸闷气短，动则尤甚，面色苍白，形寒肢冷。舌淡苔白，脉虚弱或沉细无力。【治法】温补心阳，安神定悸。心悸之心脾两虚证【症状】心悸气短，头晕目眩，失眠健忘，面色无华，倦怠乏力，纳呆食少。舌淡红，脉细弱。【治法】补血养心，益气安神（A错）。心悸之瘀阻心脉证【症状】心悸不安，胸闷不舒，心痛时作，痛如针刺，唇甲青紫。舌质紫暗或有瘀斑，脉涩或结或代。【治法】活血化瘀，理气通络（B错）。心悸之阴虚火旺证【症状】心悸易惊，心烦失眠，五心烦热，口干，盗汗，思虑劳心则症状加重，伴耳鸣腰酸，头晕目眩，急躁易怒。舌红少津，苔少或无，脉细数。【治法】滋阴清火，养心安神（C错）。胸痹之寒凝心脉证【症状】猝然心痛如绞，心痛彻背，喘不得卧，多因气候骤冷或骤感风寒而发病或加重，伴形寒，甚则手足不温，冷汗自出，胸闷气短，心悸，面色苍白。舌质紫暗，或有瘀斑瘀点，苔薄，脉沉紧或沉细。【治法】辛温散寒，宣通心阳（E错）。